关于嗜酸性淋巴肉芽肿的特点，叙述正确的一项是
A. 亦称化脓性肉芽肿
B. 又称外周性巨细胞肉芽肿
C. 是一种少见的原发性牙源性恶性肿瘤
D. 异常增生的上皮细胞突破基底膜向间质浸润性生长
E. 缓慢增大的无痛性肿块，且酸性粒细胞增多

正确答案：E。缓慢增大的无痛性肿块，且酸性粒细胞增多

解析：骨化纤维瘤是一种边界清楚、由富于细胞的纤维组织和表现多样的矿化组织构成的病变。巨细胞性龈瘤又称外周性巨细胞肉芽肿。分叶状毛细胞血管瘤亦称化脓性肉芽肿。成釉细胞癌是一种少见的原发性牙源性恶性肿瘤。嗜酸性淋巴肉芽肿表现为缓慢增大的无痛性包块，可呈对称性，患部皮肤常有瘙痒和色素沉着，酸性粒细胞增多。鳞状细胞癌主要病理变化是异常增生的上皮细胞突破基底膜向间质浸润性生长。掌握“血管瘤及嗜酸性淋巴肉芽肿”知识点。